男性，8岁。额部多发性疖肿，未治，红肿扩大，弛张性高热，4天后臀部皮下又发现一肿块，疼痛，压痛明显，且有波动感，治疗方案为
A. 醇浴退热
B. 额部疖肿换药
C. 臀部脓肿切开引流及抗生素治疗
D. 加强营养，增强抵抗力
E. 综合应用多种抗生素

正确答案：C。臀部脓肿切开引流及抗生素治疗

解析：患者已诊断为疖，后出现弛张性高热（又称败血症热型。体温常在39℃以上，波动幅度大，24小时内波动范围超过2℃，但都在正常水平以上。常见于败血症及化脓性炎症等），臀部新发肿块，提示感染扩散。臀部肿块压痛明显且有波动感提示脓肿形成并已成熟，应及时切开排脓（二版八年制外科学）（C对）。醇浴退热（A错）、额部疖肿换药（B错）、加强营养，增强抵抗力 （D错）均为支持治疗，不能从根本上治愈脓肿。不对脓肿进行切开，而单独应用多种抗生素（E错）效果不佳。